除8种必需氨基酸外，婴儿还包括
A. 色氨酸
B. 组氨酸
C. 赖氨酸
D. 酪氨酸
E. 蛋氨酸

正确答案：B。组氨酸